对癫病大发作有效的药物有
A. 苯妥英钠
B. 苯巴比妥
C. 硫喷妥钠
D. 丙戊酸钠
E. 戊巴比妥

正确答案：A、B、D。苯妥英钠；苯巴比妥；丙戊酸钠

解析：本题考查抗癫痫药。对癫病大发作有效的药物有苯妥英钠（A对）、苯巴比妥（B对）、丙戊酸钠（D对）。癫痫大发作是指强直-阵挛性发作，首选卡马西平、拉莫三嗪、丙戊酸钠或托吡酯。苯妥英钠用于治疗强直-阵挛性发作、单纯及复杂部分性发作、继发性全面发作和癫痫持续状态；可用于治疗三叉神经痛、隐性营养不良性大疱性表皮松懈症、发作性舞蹈手足徐动症、发作性控制障碍、肌强直症及三环类抗抑郁药过量时心脏传导障碍等；适用于洋地黄中毒所致的室性及室上性心律失常。苯巴比妥为巴比妥类抗癫痫药。该类药的抗癫痫作用机制在于通过增强γ-氨基丁酸A型受体活性，抑制谷氨酸兴奋性，抑制中枢神经系统单突触和多突触的传递，增加运动质的电刺激阈值，从而提高癫痫发作的阈值，抑制病灶异常放电向周围正常脑组织扩散，对癫痫大发作有效。硫喷妥钠（C错）是超短效镇静催眠药，戊巴比妥（E错）则是短效镇静催眠药，二者对癫痫大发作无效。